引起冠状血管舒张最强的因素是
A. 缺O₂
B. H⁺浓度增加
C. 组胺
D. 腺苷
E. 前列腺素

正确答案：D。腺苷